流行病学实验研究中，实验组与对照组的最大不同是
A. 样本量不同
B. 观察指标不同
C. 干预措施不同
D. 实验终点不同
E. 观察对象的构成不同

正确答案：C。干预措施不同